手足三阴经交接于
A. 腹部内脏
B. 胸部内脏
C. 手部
D. 足部
E. 头部

正确答案：B。胸部内脏

解析：十二经脉的交接规律：①相表里的阴经与阳经在四肢末端交接（CD错），如手太阴肺经和手阳明大肠经在食指端交接。②同名的手足阳经在头面部交接（E错），如手阳明大肠经与足阳明胃经在鼻翼旁交接。③足、手阴经在胸中交接（B对），如足太阴脾经与手少阴心经在心中交接。